含有马兜铃酸的中药是
A. 细辛
B. 关木通
C. 洋金花
D. 天仙藤
E. 青木香

正确答案：A、B、D、E。细辛；关木通；天仙藤；青木香

解析：本题考查的是含马兜铃酸的中药。含有马兜铃酸的中药是细辛（A对）、关木通（B对）、天仙藤（D对）与青木香（E对）。马兜铃酸有较强的肾毒性，易导致肾功能衰竭。含有马兜铃酸的中药有马兜铃、关木通、广防己、细辛、天仙藤、青木香、寻骨风等。洋金花（C错）主要化学成分为莨菪烷类生物碱。食用过量或误食易致中毒。